试验方法的串联可使
A. 灵敏度提高
B. 特异度提高
C. 两者均可
D. 两者均否

正确答案：B。特异度提高

解析：本题考查串联试验。串联试验也称系列试验，即一组筛检试验按一定的顺序相连，初筛阳性者进入下一轮筛检，全部筛检试验结果均为阳性者才定为阳性。采用两项筛检试验串联使用，可以使筛检试验的特异度增加（B对ACD错），但会使灵敏度降低。